《中国药典》规定，含量测定成分属于三萜皂苷的中药是
A. 葛根
B. 柴胡
C. 艾叶
D. 知母
E. 前胡

正确答案：B。柴胡

解析：本题考查的是柴胡的化学成分。《中国药典》规定，含量测定成分属于三萜皂苷的中药是柴胡（B对）。柴胡中含有的总皂苷为1.6%～3.8%。柴胡中所含皂苷均为三萜皂苷，柴胡皂苷是柴胡的主要有效成分。《中国药典》以柴胡皂苷a和柴胡皂苷d为指标成分对柴胡药材进行含量测定。要求两者的总含量不少于0.30%。葛根（A错）含异黄酮类化合物，主要成分有大豆素、大豆苷、大豆素-7,4'-二葡萄糖苷及葛根素、葛根素-7-木糖苷。《中国药典》以葛根素为指标成分进行含量测定，要求含葛根素不得少于2.4%。艾叶（C错）的化学成分主要有挥发油、黄酮和三萜类成分。其中艾叶含挥发油0.45%～1.00%，《中国药典》以桉油精（桉叶素）和龙脑为指标成分，采用气相色谱法进行含量测定，要求桉油精不得少于0.050%，含龙脑不得少于0.020%。知母（D错）中的化学成分主要为甾体皂苷和芒果苷，还含有木脂素、甾醇、鞣质、胆碱等成分。《中国药典》上将知母皂苷BⅡ和芒果苷定为知母药材的质量控制成分，要求知母皂苷BⅡ含量不得少于3.0%，芒果苷的含量不得少于0.7%。前胡（E错）主要化学成分为多种类型的香豆素及其糖苷、三萜糖苷及甾体糖苷、挥发油等。一般以香豆素类成分作为前胡定量质量控制的指标。《中国药典》采用高效液相色谱法测定药材中白花前胡甲素和白花前胡乙素含量，其中白花前胡甲素含量不少于0.90%，白花前胡乙素不少于0.24%。